女性，48岁。反复双手近端指间关节、双膝关节痛伴晨僵2年，肘部伸侧可触及皮下结节，质硬无触痛。诊断首先考虑
A. 风湿性关节炎
B. 系统性红斑狼疮
C. 痛风
D. 骨性关节炎
E. 类风湿关节炎

正确答案：E。类风湿关节炎

解析：中年女性患者，反复双手近端指间关节、双膝关节痛伴晨僵2年（类风湿关节炎典型关节表现），肘部伸侧可触及皮下结节，质硬无触痛（类风湿结节表现），诊断首先考虑为类风湿性关节炎（E对）。风湿性关节炎（A错）最常见于5～15岁的儿童和青少年，关节炎呈游走性、多发性，以膝、髋、踝、肘、肩等大关节受累为主，手足的小关节少见，临床表现为关节红、肿、热、痛明显，晨僵少见（P805）。系统性红斑狼疮（B错）多见于20～40岁的育龄期女性，常出现皮疹，以颊部蝶形红斑最具特征性，多伴有全身症状，发热、疲倦、乏力、体重下降等，无皮下结节（P816）。痛风（C错）多在午夜或清晨突然起病，关节剧痛，数小时内出现受累关节的红、肿、热、痛和功能障碍，单侧踇趾及第1跖趾关节最常见（P861）。骨关节炎（D错）为退行性骨关节病，多见于50岁以上者，主要累及膝、脊柱等负重关节（P858）。